任脉为
A. 气海
B. 血海
C. 阳脉之海
D. 阴脉之海
E. 十二经脉之海

正确答案：D。阴脉之海

解析：本题考查的是任脉的基本的功能。任脉为阴脉之海（D对）。任脉的基本功能：（1）调节阴经气血，故称“阴脉之海”。（2）主持妊养胞胎。气海（A错）指宗气在胸中的聚集之处。宗气，是积于胸中之气。宗气在胸中集聚之处，称为“气海”，又称“膻中”。血海（B错）与十二经脉之海（E错）指冲脉。冲脉的基本功能：（1）调节十二经气血，故称“十二经脉之海”。（2）冲为血海，有促进生殖之功能，并同妇女的月经有着密切的联系。阳脉之海（C错）指督脉。督脉的基本功能：（1）调节阳经气血，故称“阳脉之海”。（2）与脑、髓和肾的功能有关。